肺通气的直接动力是
A. 肺内压与胸内压之差
B. 胸内压与跨壁压之差
C. 大气压与肺内压之差
D. 大气压与胸内压之差
E. 大气压与跨壁压之差

正确答案：C。大气压与肺内压之差

解析：肺通气的直接动力是大气压与肺内压之差（C对）。